男、38岁。性欲减退、阳萎3年，近1年轻度头痛。头颅磁共振（MRI）检查发现高2.8cm垂体大腺瘤、压迫视神经交叉、浸润左侧海绵窦。第二天晨取血查垂体及其靶腺功能后接受了γ-刀垂体外照射放射治疗。5天后化验报告血睾酮水平0.7mmol/L、FSH及LH均＜2mIU/L（垂体-性腺轴功能减低），血PRL、GH、ACTH及TSH、T₃、T₄水平均无特殊，符合垂体无功能性大腺瘤。本例垂体腺瘤治疗
A. 采用γ-刀放射治疗是合理的选择
B. 用睾酮类药物替代治疗后再放射治疗
C. 首选溴隐亭等多巴胺激动剂治疗
D. 手术治疗、术后加用放射治疗
E. 无功能性垂体腺瘤可暂不处理观察1～2年

正确答案：D。手术治疗、术后加用放射治疗

解析：该患者确诊为无功能性垂体大腺瘤（肿瘤直径大于1cm），且有明显的压迫症状，应首选手术治疗，术后加用放射治疗（D对）。γ-刀放射治疗（A错）适用于垂体微腺瘤（肿瘤直径小于1cm）和生长激素瘤，该患者为垂体大腺瘤，故不选。放射治疗，GH瘤对放射较敏感，其他垂体腺瘤 均不敏感9（B错）。溴隐亭等多巴胺激动剂（C错）主要用于泌乳素瘤的治疗，可使90%PRL瘤体积缩小，但对无功能性腺瘤的治疗无明显效果。患者虽为无功能垂体腺瘤，但由于肿瘤体积较大，而且已出现明显的压迫症状，应及时手术切除（E错）。